未取得麻醉药品和第一类精神药品处方资格的执业医师甲和处方调配人员乙合谋，擅自为某吸毒人员开具麻醉药品，造成严重后果。根据《麻醉药品和精神药品管理条例》，关于执业医师甲和处方调配人员乙的法律责任的说法，错误的是
A. 应吊销执业医师甲的执业证书
B. 应暂停执业医师甲的执业活动，要求重新参加麻醉药品和精神药品使用知识的培训和考核后再上岗执业
C. 应吊销处方调配人员乙的执业证书
D. 如果执业医师甲和处方调配人员乙构成犯罪的应追究刑事责任

正确答案：B。应暂停执业医师甲的执业活动，要求重新参加麻醉药品和精神药品使用知识的培训和考核后再上岗执业

解析：本题考查违反麻醉药品和精神药品管理规定的法律责任。根据《麻醉药品和精神药品管理条例》，关于执业医师甲和处方调配人员乙的法律责任的说法，错误的是应暂停执业医师甲的执业活动，要求重新参加麻醉药品和精神药品使用知识的培训和考核后再上岗执业（B错，为本题正确答案）。执业医师违反麻醉药品和精神药品管理规定的法律责任：根据《麻醉药品和精神药品管理条例》第七十三条第二款规定，未取得麻醉药品和第一类精神药品处方资格的执业医师擅自开具麻醉药品和第一类精神品处方的，由县级以上卫生健康主管部门给予警告，暂停执业活动；造成严重后果的，吊销其执业证书（A对）；构成犯罪的，依法追究刑事责任（D对）。处方调配人、核对人违反麻醉药品和精神药品管理规定的法律责任：根据《麻醉药品和精神药品管理条例》第七十三条第三款规定，处方的调配人、核对人违反规定，未对麻醉药品和第一类精神药品处方进行核对，造成严重后果的，由原发证部门吊销其执业证书（C对）。